关于SARS的流行特征不正确的是
A. 主要发生于人口密度较大的都市
B. 农村地区病例少
C. 有明显的居民楼聚集现象
D. 儿童发病率高
E. 可通过交通工具远距离传播

正确答案：D。儿童发病率高

解析：人群普遍易感，但SARS发病者以青壮年居多，儿童和老人少见（D错，为本题正确的答案）；主要发生于人口密度较大的都市（A对），农村地区病例少（B对）；有明显的居民楼聚集现象（C对）；内地疫情首先在广东发生流行，其后远程传播到山西、四川、北京等地，再向全国其他地区扩散，可通过交通工具远距离传播（E对）。